不属于济川煎组成药物的是
A. 芍药
B. 牛膝
C. 泽泻
D. 升麻
E. 枳壳

正确答案：A。芍药

解析：本题考查济川煎的组成，属于记忆内容。济川煎功用温肾益精，润肠通便，由当归、牛膝（B错）、肉苁蓉、泽泻（C错）、升麻（D错）、枳壳（E错）组成。芍药不包括于济川煎中（A对）。记忆：趣记，济川从容归西，只剩泽泻。肉苁蓉，当归，牛膝，枳壳，升麻，泽泻。